全口义齿合适的凹形磨光面形态可以
A. 降低咀嚼效能
B. 使发音清晰
C. 帮助义齿固位
D. 避免咬颊、咬舌
E. 增加面部丰满度

正确答案：C。帮助义齿固位

解析：本题考查基托磨光面形态。全口义齿合适的凹形磨光面形态可以帮助义齿固位（C对）。磨光面是义齿与唇、颊、舌肌接触的部分，磨光面与义齿的水平力量有关，是保持义齿稳定的表面，使口腔内舌有口外的唇颊肌肉力量经常处于平衡状态，如果磨光面倾斜度不合适，则肌肉所施加的力量不但无助于固位和稳定，还会导致义齿脱位。义齿垂直距离过低导致咀嚼无力，或垂直距离过高导致咀嚼费力，咀嚼肌易疲劳（A错）；人工牙排列位置不正确等会导致发音障碍（B错）；后牙覆盖过小，可导致咬颊或咬舌（D错）；人工牙的选择和排列会影响面部的丰满度（E错）。